替罗非班的作用机制是
A. 拮抗维生素K
B. 阻断血小板糖蛋白Ⅱb/Ⅲa受体
C. 抑制凝血酶
D. 抑制凝血因子Xa
E. 抑制凝血因子Ⅱa

正确答案：B。阻断血小板糖蛋白Ⅱb/Ⅲa受体

解析：本题考查替罗非班的作用机制。替罗非班是一种非肽类的血小板糖蛋白Ⅱb/Ⅲa受体（B对）的可逆性拮抗剂，阻止纤维蛋白原与糖蛋白Ⅱb/Ⅲa结合，因而阻断血小板的交联及血小板的聚集。维生素K拮抗剂（A错）有华法林。直接凝血酶抑制剂（C错）为达比加群酯。抑制凝血因子Xa（D错）有利伐沙班。抑制凝血因子Ⅱa（E错）的主要是达比加群酯。